使用强心苷的心力衰竭患者，不宜选用的药品是
A. 果糖
B. 氯化钾
C. 氯化钙
D. 硫酸镁
E. 葡萄糖

正确答案：C。氯化钙

解析：本题考查强心苷的使用。强心苷能够提高细胞内钙离子水平，与氯化钙（C对）合用会加大中毒的危险。果糖（A错）不能与碱性药物及钙剂合用。氯化钾（B错）不能与利尿剂螺内酯合用。硫酸镁（D错）不能与阿片类镇痛药合用。葡萄糖（E错）与洋地黄类强心苷合用时及时补钾即可避免中毒。